治疗绝经前后诸症烦躁失眠者，应选取的配穴是
A. 中脘，阴陵泉
B. 关元，命门
C. 风池，太冲
D. 心俞，神门
E. 照海，阴谷

正确答案：D。心俞，神门

解析：题干中出现绝经前后诸症烦躁失眠是由于心肾不交所致，应配心俞、神门（D对）。肝阳上亢者，选风池、太冲（C错）。绝经前后诸症属痰气郁结加中脘、丰隆（A错）属肾阳不足加关元、命门（B错）属肾阴亏虚加照海、阴谷（E错）。用耳针法治疗绝经前后诸症选神门（D错）。